某女，42岁。患白带增多、阴部瘙痒半年，医生诊为湿热下注，处以内服中药并外用妇必舒阴道泡腾片，妇必舒阴道泡腾片的处方组成为苦参、蛇床子、大黄、百部、乌梅、硼砂、冰片、白矾、甘草，据文献报道该阴道泡腾片有抗菌消炎作用。按《中国药典》规定，妇必舒阴道泡腾片应检查
A. 溶化性
B. 溶出度
C. 发泡量
D. 融变时限
E. 分散均匀性

正确答案：C。发泡量

解析：本题考查的是片剂的质量要求。按《中国药典》规定，妇必舒阴道泡腾片应检查发泡量（C对）。阴道泡腾片应检查发泡量。含片、舌下片、可溶片按崩解时限检查法检查其溶化性（A错）。分散片、以难溶性原料药物制成的口崩片应检查溶出度（B错），并符合各品种项下的规定。阴道片应检查融变时限（D错）。分散片需检查分散均匀性（E错）。